关于蛋白质二级结构的叙述，正确的是
A. 氨基酸的排列顺序
B. 每一氨基酸侧链的空间构象
C. 局部主链的空间构象
D. 亚基间相对的空间位置
E. 每一原子的相对空间位置

正确答案：C。局部主链的空间构象